石斛夜光丸的功能是
A. 滋阴补肾，清肝明目
B. 补益肝肾，活血明目
C. 活血化瘀，养肝明目
D. 清热散风，明目退翳
E. 泻火明目，利尿通便

正确答案：A。滋阴补肾，清肝明目

解析：本题考查的是石斛夜光丸的功能。石斛夜光丸的功能是滋阴补肾，清肝明目（A对）。石斛夜光颗粒：【功能】滋阴补肾，清肝明目。明目蒺藜丸：【功能】清热散风，明目退翳（D错）。功能为补益肝肾，活血明目（B错）、活血化瘀，养肝明目（C错）或泻火明目，利尿通便（E错）的中成药，2022年考试指南未明确说明。